绞窄性疝为
A. 疝内容物易回纳入腹腔
B. 疝内容物不能完全回纳入腹腔
C. 疝内容物有动脉性血循环障碍
D. 疝内容物被疝环卡住不能还纳，但无动脉性循环障碍
E. 疝内容为部分肠壁

正确答案：C。疝内容物有动脉性血循环障碍

解析：绞窄性疝指由于嵌顿时间过长，导致疝内容物发生动脉性血循环障碍的疝（C对）。疝内容物很容易回纳入腹腔的疝（A错）为易复性疝。疝内容物不能回纳或不能完全回纳入腹腔内（B错），但不引起严重症状的疝为难复性疝。疝内容物被疝环卡住不能还纳，但无动脉性循环障碍的疝（D错）为嵌顿疝。疝内容物仅为部分肠壁（E错），系膜侧肠壁及其系膜并未进入疝囊的疝称为肠管壁疝或Richter疝，属嵌顿性疝。各种疝的特点总结如下：①易复性疝：疝块容易回纳，疝内容物无血运障碍、坏死；②难复性疝：疝块不能回纳或不能完全回纳，疝内容物无血运障碍、坏死；③嵌顿性疝：疝块不能回纳，疝内容物静脉回流障碍、动脉循环正常；④绞窄性疝：疝块不能回纳，疝内容物动、静脉性循环障碍、坏死，并可继发感染。Littre疝指疝内容物为小肠憩室（通常是Meckel憩室）的疝，属于嵌顿性疝。